体型正常的人要保持适宜体重，应
A. 减少摄食量
B. 增加蔬菜摄入量
C. 减少脂肪摄入量
D. 剧烈运动
E. 食量与体力活动要平衡

正确答案：E。食量与体力活动要平衡